高剂量TI-Ag
A. 引起T细胞免疫耐受
B. 引起B细胞免疫耐受
C. 引起T、B细胞免疫耐受
D. 不引起免疫耐受
E. 引起免疫抑制

正确答案：B。引起B细胞免疫耐受